起病急，体温40℃，频泻，大便为黏冻状含脓血，里急后重，全身中毒症状重，最可能的病原菌为
A. 出血性大肠埃希菌肠炎
B. 真菌性肠炎
C. 金黄色葡萄球菌、
D. 侵袭性大肠杆菌肠炎
E. 空肠弯曲菌肠炎

正确答案：D。侵袭性大肠杆菌肠炎

解析：急性起病，高热，腹泻，里急后重，大便为黏冻状含脓血，全身中毒症状中，最可能的病原菌为侵袭性大肠杆菌肠炎（D对），出血性大肠埃希菌肠炎（A错）大便的性状开始为黄色水样便，后转为血水便，有特殊臭味。真菌性肠炎（B错）大便次数增多，黄色稀便，泡沫较多，带黏液，有时可见豆腐渣样细块（菌落）。金黄色葡萄球菌（C错）典型大便为暗绿色，量多带黏液，少数为血便，多继发于使用大量抗生素后。空肠弯曲菌肠炎（E错）大便性状为脓血状。